代谢性酸中毒时血气分析参数的改变是
A. HCO₃⁻降低
B. SB、AB、BB均降低
C. pH下降
D. PaCO₂降低
E. 以上都是

正确答案：E。以上都是

解析：代谢性酸中毒（A对）时固定酸增多和（或）HC03一丢失过多，所以HCO₃⁻降低，AB和SB都受代谢因素影响，由于HC03一丢失，两者都降低。HC03一丢失后血液中具有缓冲作用的负离子碱会减少，所以BB也降低，故SB、AB、BB 均降低（B对）。pH本身不能区分酸碱平衡紊乱的类型，但只要是失代偿性酸中毒PH都会下降（C对）。PH下降后可通过刺激颈动脉体和主动脉体化学感受器，反射性引起呼吸中枢兴奋，导致呼吸加深加快，CO2排除过多，PaCO₂降低（D对，故E为本题正确答案）。